在发展中国家水污染最突出的问题仍是
A. 放射性污染
B. 化学性污染
C. 生物性污染
D. 热污染
E. 原生污染

正确答案：C。生物性污染

解析：本题考查发展中国家水污染最突出的问题。发展中国家的水污染问题仍是世界性的大问题，许多发展中国家的水体受到了不同程度的污染，其中比较突出的污染形式是生物性污染（C对ABDE错）。首先，生物性污染是发展中国家水污染最严重的污染形式，特别是城市和工业发展较快的国家。由于发展中国家在经济发展过程中，投入资源及技术投入居民消费的比例较小，城市及工业污水处理设施的建设落后，因此产生的污水未经深度处理，直接排入河流湖泊，造成大量的生物性污染，如有机物污染、病原微生物污染、悬浮物污染等，严重影响水体质量。其次，发展中国家大量农药和化肥的使用，也是造成发展中国家生物性污染的主要原因之一。农药和化肥的使用量在发展中国家较大，而农药和化肥的残留物也可以通过雨水、河水等水体输移到水体中，使水体微生物群落失去平衡，造成水体生物性污染，使水体失去自然的生态环境。再次，由于发展中国家的排污设施落后，大量的生活垃圾仍然直接倾倒到水体中，污染水体，特别是沿海地区和河口处，更容易造成生物性污染。大量的生活垃圾排入水体，污染物的含量增加，水体环境发生变化，水体微生物群落失去平衡，造成水体生物性污染。此外，发展中国家尚未完全建立完善的生活污水处理系统，大量的生活污水排入水体，大量的污染物排入水体，使水体环境发生变化，使水体微生物群落失去了平衡，造成发展中国家水体生物性污染。综上所述，发展中国家水污染最突出的问题仍是生物性污染。农药和化肥的使用，排污设施落后，生活垃圾的排放，生活污水的排放，都是造成发展中国家水体生物性污染的主要原因。